长期大量饮酒导致上消化道出血最常见的原因
A. 胃角溃疡出血
B. 胃贲门黏膜撕裂
C. 胃食管静脉曲张破裂出血
D. 胃横动脉出血
E. 十二指肠球部溃疡

正确答案：C。胃食管静脉曲张破裂出血

解析：长期大量喝酒会造成慢性的酒精性肝病，最后导致肝硬化的发生，肝硬化形成过程当中会因为门静脉高压，侧支循环的建立，导致食道胃底静脉曲张，在食用较硬的食物的情况下，可以导致曲张血管的破裂出血，引起上消化道出血。